男，50岁，高热，全身酸痛，咳嗽2天入院，咳少量脓痰，既往体健，查体：T39.8℃，P69次/分，R30次/分，BP90/60mmHg，口唇发绀，双下肺可闻及湿啰音，血WBC12.8×10⁹/L，N0.85，胸部X线片示双下肺斑片状阴影，无空洞，右侧少量胸腔积液，血气分析是Ⅰ型呼吸衰竭。该患者如采用单药治疗，下列药物中首选的是
A. 头孢曲松
B. 左氧氟沙星
C. 奥司他韦
D. 万古霉素
E. 碳青霉烯类

正确答案：B。左氧氟沙星

解析：患者高热、咳嗽、咳痰，肌痛、相对缓脉，胸部X线片示双下肺斑片状阴影，无空洞。最可能的诊断为军团菌肺炎。首选大环内酯类（红霉素）或喹诺酮类抗生素（左氧氟沙星）（B对）。头孢曲松（A错）、碳青霉烯类（E错）属于β-内酰胺类抗生素。万古霉素（D错）属于多肽类抗生素。奥司他韦（C错）属于抗病毒药。